关于弥漫性大B细胞淋巴瘤的描述，正确的是
A. 是一类大B淋巴样细胞构成的肿瘤，呈弥漫性生长模式
B. 肿瘤细胞的胞核可为正常淋巴细胞核的2倍以上
C. 淋巴结结构大部分或全部被均质鱼肉状的瘤组织取代
D. 结外弥漫性大B细胞淋巴瘤常形成瘤块，伴有或不伴有纤维化
E. 以上均正确

正确答案：E。以上均正确

解析：弥漫性大B细胞淋巴瘤是一类大B淋巴样细胞构成的肿瘤，呈弥漫性生长模式，肿瘤细胞的胞核相当于甚至超过正常巨噬细胞的胞核，或为正常淋巴细胞核的2倍以上。淋巴结结构大部分或全部被均质鱼肉状的瘤组织取代。偶尔病变仅局部生长。可出现出血坏死。结外弥漫性大B细胞淋巴瘤常形成瘤块，伴有或不伴有纤维化。典型的表现是正常的淋巴结构或结外组织被弥漫性的淋巴组织取代。掌握“恶性淋巴瘤”知识点。